下列经空气传播的微生物，除外的是
A. 水痘病毒
B. 麻疹病毒
C. 风疹病毒
D. 流行性腮腺炎病毒
E. 破伤风杆菌

正确答案：E。破伤风杆菌

解析：本题考查口腔医疗保健中的感染中经空气传播的微生物及疾病。破伤风杆菌（E错，为本题正确答案）不是经空气传播的微生物。